涎石病好发于
A. 下颌下腺
B. 舌下腺
C. 腮腺
D. 唇腺
E. 腭腺

正确答案：A。下颌下腺

解析：本题考查涎石病及下颌下腺炎。涎石病是在腺体或导管内发生钙化性团块而引起的一系列病变。85%左右发生于下颌下腺（A对）。